颅底的孔、裂及其交通正确的是
A. 卵圆孔通眶
B. 眶上裂通眶上孔
C. 筛孔通蝶筛隐窝
D. 圆孔通翼腭窝
E. 内耳门通鼓室

正确答案：D。圆孔通翼腭窝

解析：翼腭窝向后借圆孔通颅中窝（D对）。眶上裂（B错）、眶下裂通眶（A错）。筛板上有筛孔通鼻腔（C错）。内耳门通入内耳道（E错）。